碘酊中碘化钾的作用是
A. 絮凝
B. 增溶
C. 助溶
D. 潜溶
E. 盐析

正确答案：C。助溶

解析：本题考查液体制剂常用的附加剂。碘酊中碘化钾的作用是助溶（C对）；絮凝（A错）是指使水或液体中悬浮微粒集聚变大，或形成絮团，从而加快粒子的聚沉，达到固-液分离的目的；增溶（B错）是指难溶性药物在表面活性剂的作用下，在溶剂中增加溶解度并形成溶液的过程；潜溶（D错）是指当混合溶剂中各溶剂达某一比例时,药物的溶解度比在各单纯溶剂中溶解度大的现象；盐析（E错）指在蛋白质水溶液中加入中性盐，随着盐浓度增大而使蛋白质沉淀出来的现象。